足月女婴，25天，出生后2周出现身黄，目黄，其色晦暗，持续不退，精神差，吮乳少，易呕吐，尿黄，四肢欠温，腹胀便溏，舌质淡，苔白腻，指纹色淡。其治宜选
A. 茵陈蒿汤加减
B. 茵陈理中汤加减
C. 血府逐瘀汤加减
D. 羚角钩藤汤加减
E. 茵陈四苓散加减

正确答案：B。茵陈理中汤加减

解析：患儿出生两周后出现身黄，目黄，其色晦暗，持续不退，起病缓慢，病程较长，诊断为黄疸之阴黄证。寒湿内阻，肝胆疏泄失常，则皮肤面目发黄；湿从寒化，寒为阴邪，故面目皮肤色泽晦暗；脾肾阳虚，运化、温煦失职则精神差，吮乳少，易呕吐，尿黄，四肢欠温，腹胀便溏；舌质淡，苔白腻均属寒湿之象。治疗宜温中化湿退黄，主方为茵陈理中汤加减（B对）。茵陈蒿汤加减为阳黄之湿热熏蒸证的代表方剂，其临床表现为面目皮肤发黄，颜色鲜明，精神疲倦或烦躁啼哭，不欲吮乳，或有发热，大便秘结，小便短黄，舌质红，舌苔黄腻（A错）。血府逐瘀汤为阴黄之瘀积发黄证的代表方剂，其证候为面目皮肤发黄，颜色晦滞，日益加重，腹部胀满，右胁下痞块，神疲纳呆，小便短黄，大便不调或灰白，舌紫暗有瘀斑、瘀点，舌苔黄或白（C错）。羚角钩藤汤为胎黄动风证的代表方，临床以黄疽迅速加深，伴神昏、抽搐为特征（D错）。茵陈四苓汤治黄疸，小便深黄，大便溏薄（E错）。